含有吡咯里西啶类生物碱，且有肝、肾毒性的中药是
A. 防己
B. 延胡索
C. 何首乌
D. 千里光
E. 王不留行

正确答案：D。千里光

解析：本题考查的是千里光的化学成分。含有吡咯里西啶类生物碱，且有肝、肾毒性的中药是千里光（D对）。千里光中所含有的生物碱主要为吡咯里西啶类生物碱，主要化学成分有千里光宁碱、千里光菲宁碱及痕量的阿多尼弗林碱等；同时含有黄酮苷等成分。千里光在临床应用中应注意的问题：千里光具有肝、肾毒性和胚胎毒性，在使用时应该严格注意。《中国药典》以阿多尼弗林碱为指标成分进行限量测定，其中阿多尼弗林碱的含量不得过0.004%。防己（A错）的有效成分为生物碱，总生物碱含量可达2.3%～5%，其中汉防己甲素（粉防己碱），约为1%，汉防己乙素（防己诺林碱）约为0.5%。《中国药典》以粉防己碱和防己诺林碱为指标成分进行含量测定，对药材要求两者总量不得少于1.6%；对饮片要求两者总量不得少于1.4%。延胡索（B错）含有多种苄基异喹啉类生物碱，包括延胡索甲素、延胡索乙素和去氢延胡索甲素等，这些生物碱的类型为原小檗碱型、原托品碱型、阿朴菲型等六种异喹啉型生物碱，其中多数属原小檗碱型。《中国药典》以延胡索乙素为指标成分进行含量测定，要求含量不得少于0.050%。何首乌（C错）的主要成分为蒽醌类成分，以大黄素、大黄酚、大黄素甲醚、大黄酸、芦荟大黄素等为主，《中国药典》以二苯乙烯苷和结合蒽醌为指标成分进行含量测定，要求何首乌含二苯乙烯苷不得少于1.0%，制何首乌含二苯乙烯苷不得少于0.70%；对何首乌和制何首乌要求结合蒽醌均不得少于0.10%（以大黄素和大黄素甲醚计）。王不留行（D错）的成分，2020年考试指南中未明确说明。王不留行主要含有三萜皂苷、黄酮苷、环肽以及氨基酸类等化学成分。《中国药典》以王不留行黄酮苷为指标成分进行含量测定，其中含王不留行黄酮苷不得少于0.15%。